阿司匹林性质有
A. 分子中有酚羟基
B. 分子中有羧基呈弱酸性
C. 不可逆抑制环氧化酶具有解热镇痛抗炎
D. 小剂量预防血栓
E. 易水解，水解药物容易被氧化为有色物质

正确答案：B、C、D、E。分子中有羧基呈弱酸性；不可逆抑制环氧化酶具有解热镇痛抗炎；小剂量预防血栓；易水解，水解药物容易被氧化为有色物质

解析：本题考查阿司匹林。阿司匹林分子结构中含有羧基，显弱酸性（B对）。阿司匹林分子结构中含有酯键，能缓慢水解生成水杨酸和乙酸，在空气中久置易被氧化成醌型有色物质（E对）。阿司匹林为环氧化酶的不可逆抑制剂，通过阻断前列腺素的生物合成起到解热、镇痛、抗炎的作用（C对）；也可减少血小板血栓素A₂的生成，起到抑制血小板聚集和防止血栓形成的作用（D对）。